表面麻醉不适用于
A. 表浅的黏膜下脓肿切开引流
B. 松动的乳牙
C. 行气管内插管前的黏膜表面麻醉
D. 阻生齿拔除的麻醉
E. 松动的恒牙

正确答案：D。阻生齿拔除的麻醉

解析：表面麻醉：亦称涂布麻醉，是将麻醉剂涂布或喷射于手术区表面，麻醉药物被吸收而使末梢神经麻痹，以达到镇痛效果的局部麻醉方法。本法适用于表浅的黏膜下脓肿切开引流，拔除松动的乳牙或恒牙，以及行气管内插管前的黏膜表面麻醉。掌握“颌面部常用局麻法及牙拔除的麻醉选择”知识点。